《金匮》首篇中第一条的“治未病”是
A. 预防疾病的发生
B. 治疗未病的脏腑
C. 治疗已病和未病的脏腑
D. 在病发前服药
E. 调整阴阳平衡

正确答案：B。治疗未病的脏腑

解析：人是一个有机整体，一脏有病，可影响他脏，故上工除治已病之脏外，亦注意调治未病之脏腑。以防止疾病传变。此即“治未病”之意（B对）。根据《素问·玉机真脏论》“五脏有病，则各传其所胜”和《素间·五运行大论》“气有余，则制己所胜而侮所不胜”的理论。上工知晓肝病实证易传脾的规律，故在治肝的同时，即注意调补未病之脾，以防肝病及脾。“实脾”当根 据具体情况，因为肝病是否传脾取决于肝脾双方。脾虚易受邪，故当补益；若脾气充盛。不易受邪，即勿补之。中工不懂得肝病会传脾之理，只知见肝治肝，往往导致肝病未愈，脾病又起。